覆（牙合）的定义是
A. 牙尖交错（牙合）时，上下前牙发生重叠关系
B. 牙尖交错（牙合）时，上颌牙盖过下颌牙唇颊面间的水平距离
C. 牙尖交错（牙合）时，上颌牙盖过下颌牙唇颊面间的垂直距离
D. 牙尖交错（牙合）时，上颌牙盖过下颌牙舌面间的水平距离
E. 前伸运动时，下前牙切缘超过上前牙切缘的水平距离

正确答案：C。牙尖交错（牙合）时，上颌牙盖过下颌牙唇颊面间的垂直距离

解析：覆（牙合）：指上颌牙盖过下颌牙唇、颊面的垂直距离。如在前牙，盖过的部分不超过下前牙唇面切1/3者，称为正常覆（牙合）。掌握“牙尖交错（牙合）、前伸（牙合）及侧（牙合）”知识点。